经络作为通道，所具有的作用是
A. 运行全身气血
B. 联络脏腑肢节
C. 沟通上下内外
D. 流通水液
E. 输布精气

正确答案：A、B、C。运行全身气血；联络脏腑肢节；沟通上下内外

解析：本题考查的是经络的生理功能。经络作为通道，所具有的作用是运行全身气血（A对）、联络脏腑肢节（B对）与沟通上下内外（C对）。经络的功能活动，主要表现在沟通表里上下，联络脏腑器官，感应传导信息，以及调节人体各部分功能平衡等方面。具体为：（一）沟通联络作用：1.脏腑同外周肢节之间的联系；2.脏腑同官窍之间的联系；3.脏腑之间的联系；4.经脉与经脉之间的联系。（二）运输气血作用。（三）感应传导作用。（四）调节平衡作用。